患者小便短数，灼热刺痛，色黄赤，舌苔黄腻，脉濡数。治疗应选用
A. 大蓟
B. 地榆
C. 槐花
D. 白茅根
E. 侧柏叶

正确答案：D。白茅根

解析：小便短数，灼热刺痛，色黄赤，舌苔黄腻，脉濡数，为典型的热淋的表现，因此需要用清热利尿的白茅根治疗（D对）。大蓟（A错）的功效是凉血止血，散瘀解毒消痈。地榆（B错）的功效是凉血止血，解毒疗疮。槐花（C错）的功效是凉血止血，清肝泻火。侧柏叶（E错）的功效是凉血止血，化痰止咳，生发乌发。